首次提出“社会医学”概念的学者是
A. 法国医生盖林
B. 德国卫生学家弗兰克
C. 德国医学家格罗蒂杨
D. 比利时医生维萨里
E. 美国医学家麦克英泰尔

正确答案：A。法国医生盖林

解析：本题考查首次提出“社会医学”概念的学者。法国医师盖林（A对BCDE错）于1848年第一次提出社会医学概念。